患有下列疾病者不得直接从事供、管水工作，除外
A. 痢疾
B. 伤寒
C. 恶性肿瘤
D. 活动性肺结核
E. 戊型病毒性肝炎

正确答案：C。恶性肿瘤